缺血性脑卒中的二级预防用药中，不包括
A. 依达拉奉
B. 阿司匹林
C. 阿托伐他汀
D. 缬沙坦
E. 氯吡格雷

正确答案：A。依达拉奉

解析：本题考查缺血性脑卒中的二级预防用药。缺血性脑卒中的二级预防用药中，不包括依达拉奉（A错，为本题正确答案）。心脑血管疾病的二级预防用药包括：阿司匹林（B对）、ACEI、β受体阻断剂、控制胆固醇（如阿托伐他汀（C对））和戒烟、控制饮食和糖尿病、健康教育和运动。缬沙坦（D对）用于各种轻至中度高血压。氯吡格雷（E对）用于近期心肌梗死、近期缺血性卒中或确诊外周动脉性疾病及急性冠脉综合征，非ST段抬高性急性冠脉综合征。